预防青少年近视的根本措施是
A. 限制过多的长时间近距离视近活动
B. 合理安排青少年的睡眠时间
C. 合理安排青少年的膳食营养
D. 适当安排青少年的体育锻炼
E. 对青少年视力状况定期进行监测

正确答案：A。限制过多的长时间近距离视近活动